区别血红蛋白尿与血尿的主要方法是
A. 尿蛋白电泳
B. 尿比重
C. 尿沉渣镜检
D. 尿胆红素
E. 尿蛋白定性试验

正确答案：C。尿沉渣镜检

解析：尿沉渣镜检（C对）是将新鲜尿离心后，经显微镜检查尿沉淀物中各种有形成分的检查方法，每高倍视野红细胞超过3个，提示镜下血尿，管型尿的出现和尿泡沫增多提示血红蛋白尿。尿蛋白电泳（A错）用于大致推断尿蛋白的来源（是溢出性蛋白尿还是组织破坏性蛋白尿），并可了解肾功能的情况。尿比重（B错）用于肾髓质浓缩功能的检查。尿胆红素（D错）用于肝实质性病变的检查。尿蛋白定性试验（E错）仅提示蛋白尿。